下列药品中，需冷藏的药品有
A. 双歧杆菌三联活菌散
B. 二甲双胍片
C. 胰岛素注射液
D. 复合维生素B片
E. 酚麻美敏滴剂

正确答案：A、C。双歧杆菌三联活菌散；胰岛素注射液

解析：本题考虑药品的贮存。需冷藏的药品有双歧杆菌三联活菌散（A对）、胰岛素注射液（C对）。二甲双胍片（B错）与酚麻美敏滴剂（E错）常温密封保存即可。复合维生素B片（C错）须避光保存。